按照《药品包装、标签规范细则（暂行）》，以下关于药品包装和标签叙述正确的是
A. 药品包装必须按照企业所在地省级药品监督管理部门规定的要求印制
B. 包装、标签上都不得印有“名贵药材”字样
C. 药品的包装分为内包装和外包装
D. 药品包装、标签内容不得超出经批准的药品说明书所限定的内容
E. 药品包装、标签可以印有表述安全、合理用药的用词

正确答案：B、C、D、E。包装、标签上都不得印有“名贵药材”字样；药品的包装分为内包装和外包装；药品包装、标签内容不得超出经批准的药品说明书所限定的内容；药品包装、标签可以印有表述安全、合理用药的用词